从生物-心理-社会医学模式出发自评自己的生命质量，应选用的量表
A. 36条目简明健康量表
B. 普适性量表
C. 世界卫生组织生命质量量表简表
D. 普适性量表和特异性量表
E. 疾病影响量表

正确答案：C。世界卫生组织生命质量量表简表

解析：本题考查生命质量测定量表的选择。从生物-心理-社会医学模式出发自评自己的生命质量，应选用的量表是世界卫生组织生命质量量表简表（C对ABDE错）。